热退津复，可见
A. 舌苔厚
B. 舌苔润
C. 舌苔黄厚腻
D. 舌苔剥
E. 舌苔无根

正确答案：B。舌苔润

解析：舌苔润指舌苔润泽有津，干湿适中，舌苔由润变燥，表示热重津伤，或津失输布；舌苔由燥转润，主热退津复，或饮邪始化（B对）。舌苔厚（A错）指不能透过舌苔见到舌质者，舌苔的厚薄变化，称为舌苔的消长，舌苔由薄转厚，为舌苔长，提示邪气渐盛，或表邪入里，为病进。舌苔黄厚腻（C对）指苔质颗粒细腻致密，融合成片，如涂有油腻之状，紧贴舌面，揩之不去，刮之不脱，伴见苔色黄者，主湿热或痰热内蕴，或为食积化腐。舌苔剥（D）指舌面本有舌苔，疾病过程中舌苔全部或部分脱落，脱落处光滑无苔，提示胃气、胃阴不足，若舌苔从全到剥，是胃之气阴不足，正气渐衰的表现，反映正气的盛衰。舌苔无根（E错）指舌苔不紧贴舌面，不像舌所自生而似涂于舌面，苔易刮脱，刮后无垢而舌质光洁者，提示正气虚衰。